仙茅具有的功效是
A. 祛寒除湿
B. 祛风止痒
C. 益肝明目
D. 活血止痛
E. 温脾止泻

正确答案：A。祛寒除湿

解析：该题考查仙茅的功效。仙茅味辛，性热，有毒，归肾、肝经，其功效为温肾壮阳，祛寒除湿（A对BCDE错）。